具有硫氮杂䓬结构的治心绞痛药是
A. 盐酸地尔硫䓬
B. 硝苯吡啶
C. 盐酸普萘洛尔
D. 硝酸异山梨酯
E. 盐酸哌唑嗪

正确答案：A。盐酸地尔硫䓬

解析：本题考查盐酸地尔硫䓬。盐酸地尔硫䓬（A对）是具有硫氮杂䓬结构的抗心绞痛药。硝苯吡啶（B错）是具有二氢吡啶结构的抗心绞痛药。盐酸普萘洛尔（C错）具有氨基醇结构，可降血压、抗心律失常。硝酸异山梨酯（D错）是具有酯类结构的血管扩张药。盐酸哌唑嗪（E错）是哌嗪类的选择性α受体阻滞剂。